不属于血管神经性水肿的临床表现的是
A. 患者急性发病，症状持续数小时或数天后消失
B. 好发于头面部疏松区，唇、眼睑、舌、口底和下颌下
C. 肿胀区界限不明显，按之呈凹陷状
D. 由于神经末梢受水肿的影响，故灼热、瘙痒感明显
E. 水肿以口唇最为多见，可表现为上唇肥厚翘突，严重时可波及鼻翼和颧部

正确答案：C。肿胀区界限不明显，按之呈凹陷状

解析：血管神经性水肿的临床表现：患者急性发病，症状持续数小时或数天后消失。好发于头面部疏松区，唇、颊、眼睑、耳垂、咽喉等。上唇较下唇好发，下眼睑较上眼睑好发。开始患处皮肤或黏膜有瘙痒、灼热痛。随之发生肿胀。肿胀区界限不明显，按之较韧而有弹性。水肿可在十几分钟内形成，呈淡红色或无色泽改变。若浅层毛细血管扩张时，水肿区黏膜皮肤颜色不正常或泛红发亮。由于神经末梢受水肿的影响，故灼热、瘙痒感明显。深部水肿，肿胀范围不等，组织微硬而有弹性，但无压痛。水肿以口唇最为多见，可表现为上唇肥厚翘突，严重时可波及鼻翼和颧部。一般在数小时或1～2日内逐渐消退。但可在同一部位反复发作。掌握“血管神经性水肿”知识点。